下列中药中表面灰白色或淡红色，无光泽，凹凸不平，多孔，似蜂窝状的药材是
A. 朱砂
B. 自然铜
C. 雄黄
D. 炉甘石
E. 芒硝

正确答案：D。炉甘石

解析：本题考查的是炉甘石药材的性状鉴别。下列中药中表面灰白色或淡红色，无光泽，凹凸不平，多孔，似蜂窝状的药材是炉甘石（D对）。炉甘石：【性状鉴别】药材为块状集合体，呈不规则块状。灰白色或淡红色，表面粉性，无光泽，凹凸不平，多孔，似蜂窝状。体轻，易碎。气微，味微涩。朱砂（A错）：【性状鉴别】药材为粒状或块状集合体，呈颗粒状或块片状。鲜红色或暗红色，条痕红色至褐红色，具光泽。体重，质脆，片状者易破碎，粉末状者有闪烁的光泽。气微，味淡。自然铜（B错）：【性状鉴别】药材晶型多为立方体，集合体呈致密块状。表面亮淡黄色，有金属光泽；有的黄棕色或棕褐色，无金属光泽。具条纹，条痕绿黑色或棕红色。体重，质坚硬或稍脆，易砸碎，断面黄白色，有金属光泽；或断面棕褐色，可见银白色亮星。雄黄（C错）：【性状鉴别】药材为块状或粒状集合体，呈不规则块状。深红色或橙红色，条痕淡橘红色，晶面有金刚石样光泽。质脆，易碎，断面具树脂样光泽。微有特异臭气，味淡。精矿粉为粉末状或粉末集合体，质松脆，手捏即成粉，橙黄色，无光泽。芒硝（E错）：【性状鉴别】药材为棱柱状、长方形或不规则块状及粒状。无色透明或类白色半透明。质脆，易碎，断面呈玻璃样光泽。气微，味咸。